患者，女，36岁，已婚。两次月经中间，阴道少量出血，色鲜红；头晕腰酸，夜寐不宁，五心烦热，舌质红，苔薄，脉细数。其治法是
A. 益气补肾，固冲止血
B. 滋肾养阴，固冲止血
C. 养阴清热，固冲止血
D. 补肾养肝，固冲止血
E. 益气养阴，凉血清热

正确答案：B。滋肾养阴，固冲止血

解析：该患者两次月经中间，阴道少量出血，色鲜红，故诊断为经间期出血。经间期氤氲之时，阳气内动，若肾阴偏虚，虚火内生，虚火与阳气相搏，损伤阴络，冲任不固，故经间期发生阴道少量出血；阴虚阳动，故色鲜红，夜寐不宁，五心烦热；头晕腰酸，舌质红，苔薄，脉细数均为肾阴虚损之象，故辨为肾阴虚证，治宜滋肾养阴，固冲止血（B对）。